反映医患关系本质的是
A. 医患关系是一种民事法律关系
B. 医患关系是具有道德意义较强的社会
C. 医患关系是一种商家与消费者的关系
D. 医患关系是包括非技术性和技术性方面的关系
E. 医患关系是患者与治疗者在诊疗和保健中所建立的关系

正确答案：B。医患关系是具有道德意义较强的社会

解析：医患关系是具有道德意义较强的社会关系反映了医患关系的本质（B对AC错）。医患关系是包括非技术性和技术性方面的关系为医患关系的内容（D错）。医患关系是患者与治疗者在诊疗和保健中所建立的联系为医患技术关系（E错）。